某女，45岁。患急性支气管炎5日，症见表寒里热、身热口渴、咳嗽痰盛、喘促气逆、胸膈满闷。治当辛凉宣泄、清肺平喘，宜选用的成药是
A. 桂龙咳喘宁胶囊
B. 橘红丸
C. 小青龙合剂
D. 止嗽定喘口服液
E. 急支糖浆

正确答案：D。止嗽定喘口服液

解析：本题考查的是止嗽定喘口服液的功能。患急性支气管炎5日，症见表寒里热、身热口渴、咳嗽痰盛、喘促气逆、胸膈满闷。治当辛凉宣泄、清肺平喘，宜选用的成药是止嗽定喘口服液（D对）。止嗽定喘口服液：【功能】辛凉宣泄，清肺平喘。桂龙咳喘宁胶囊（A错）：【功能】止咳化痰，降气平喘。橘红丸（B错）：【功能】清肺，化痰，止咳。小青龙合剂（C错）：【功能】解表化饮，止咳平喘。急支糖浆（E错）：【功能】清热化痰，宣肺止咳。